下列不属慢性心衰利尿剂应用原则的是
A. 间歇使用
B. 快速利尿
C. 轻症用噻嗪类
D. 排钾、保钾类利尿剂合用
E. 伴肾功能不全时用袢利尿剂

正确答案：B。快速利尿

解析：利尿剂是心力衰竭治疗中改善症状的基石，是心衰治疗中唯一能够控制体液潴留的药物，但不能作为单一治疗。慢性心衰利尿剂为防止体液排出过多，应间歇用药（A对），为防止电解质失调，K+排出过多，常需保钾与排钾利尿剂联合应用（D对）。噻嗪类利尿剂作用于远曲小管近端和髓袢升支远端，抑制钠的重吸收，并因Na+-K+交换同时降低钾的重吸收，为轻度心率衰竭的首选药（C对）。袢利尿剂作用于髓袢升支粗段，排钠排钾，为强效利尿剂，适合用于肾功能不全者（E对）。快速利尿（B错，为本题正确答案）为急性心衰利尿剂应用指征。